男，20岁，神志不清2小时入院，既往患1型糖尿病5年，长期皮下注射胰岛素，近3天因腹泻而停用。体检：血压70/50mmHg，皮肤中度失水征，呼吸深大，有烂苹果味，心率130次/分。最可能的诊断是
A. 高渗性非酮症性糖尿病昏迷
B. 糖尿病酮症酸中毒
C. 糖尿病乳酸性酸中毒
D. 低血糖昏迷
E. 感染性休克

正确答案：B。糖尿病酮症酸中毒

解析：Ⅰ型糖尿病患者（易自发糖尿病酮症酸中毒），长期胰岛素治疗，近3天中断使用（诱因）后，呼吸深大（Kussmaul深大呼吸常提示酸中毒）、有烂苹果味（丙酮有烂苹果味，主要经呼吸道排出，提示血中丙酮含量增多），皮肤中度失水征、休克（BP70/50mmHg、P130次/分），神志不清2小时，最可能的诊断为糖尿病酮症酸中毒昏迷（B对）。高渗性非酮症性糖尿病昏迷（P748）（A错）主要见于既往无糖尿病病史的老年T2DM患者，以严重高血糖、高血浆渗透压、脱水为特征，无明显酮症（即深大呼吸、呼吸有烂苹果味）。糖尿病乳酸性酸中毒（C错）为双胍类口服降糖药物的罕见并发症，患者可出现深大呼吸，但呼气无烂苹果味。低血糖昏迷（D错）可出现意识障碍，但无脱水与酮症（呼气有烂苹果味）表现。感染性休克（E错）多有基础感染性疾病，常有高热或体温过低、血白细胞升高或明显降低，但无酮症表现。